男，45岁。饮酒、饱餐后突发左上腹持续性疼痛10小时，吐后腹痛不缓解。无慢性胃病史。最可能的诊断是
A. 心肌梗死
B. 急性胆囊炎
C. 急性胰腺炎
D. 急性胃炎
E. 肾结石

正确答案：C。急性胰腺炎

解析：中年男性患者，饮酒、饱餐后突发左上腹持续性疼痛，吐后腹痛不缓解（提示急性胰腺炎），最可能的诊断是急性胰腺炎（C对）。心肌梗死（A错）可发生于饮酒、饱餐后，但疼痛多位于胸骨体之后，可波及心前区，向左肩及左臂内侧放射，且患者大多有心脏病病史。急性胆囊炎（P443）（B错）常表现为进食油腻食物后右上腹阵发性绞痛，右上腹腹膜刺激征，Murphy氏征阳性。急性胃炎（D错）常表现为上腹部不适，恶心呕吐，可有上腹轻压痛。肾结石（P558）（E错）常表现为腰背部阵发性疼痛，可伴有肉眼血尿。